位于角化层的深面，一般由2～3层扁平细胞组成，胞质中嗜碱性透明角质颗粒的是
A. 角化层
B. 粒层
C. 棘细胞层
D. 基底层
E. 生发层

正确答案：B。粒层

解析：粒层：位于角化层的深面，棘细胞层的浅面，一般由2～3层扁平细胞组成。胞质中含有嗜碱性透明角质颗粒。掌握“口腔黏膜基本结构”知识点。